大鼠亚慢性毒性试验连续染毒的期限为
A. 2周
B. 20天
C. 60天
D. 90天
E. 1年

正确答案：D。90天